β-内酰胺类药物的抗菌作用机制是其抑制了细菌的
A. DNA螺旋酶
B. 细胞壁合成
C. 二氢叶酸合成酶
D. 核酸合成
E. 蛋白质合成

正确答案：B。细胞壁合成